患者，男，64岁。高血压病史5年，晨起突然口齿不清，口角㖞斜，左侧肢体活动障碍。应首选的检查项目是
A. 腰穿脑脊液
B. 脑血管造影
C. 脑电图
D. 头部CT
E. 脑超声波

正确答案：D。头部CT

解析：临床上对于脑血管疾病一般应首选的检查项目是头部CT（D对）或核磁共振，颅脑CT，多数脑梗死病例于发病24小时后逐渐显示与闭塞血管供血区一致的低密度梗死灶，如梗死灶体积较大，则可有占位效应，出血性梗死呈混杂密度。腰穿脑脊液（A错）通常CSF压力、常规及生化检查正常，大面积脑梗死压力可增高，出血性脑梗死CSF可见红细胞。脑血管造影（B错），DSA、CTA、MRA可显示血管狭窄和闭塞的部位，以及动脉炎、动脉瘤和血管畸形等。脑电图（C错）、脑超声波（E错）用于检查癫痫。